关于注射剂给药途径的说法，错误的是
A. 混悬型注射液可用于肌内注射
B. 乳状液型注射液不得用于静脉注射
C. 混悬型注射液不得用于静脉注射
D. 混悬型注射液不得用于椎管内注射
E. 乳状液型注射液不得用于椎管内注射

正确答案：B。乳状液型注射液不得用于静脉注射

解析：本题考查的是注射剂的质量要求。乳状液型注射液可以用于静脉注射（B错，为本题正确答案）。注射剂系指原料药物或与适宜的辅料制成的供注入体内的无菌制剂。注射剂可分为注射液、注射用无菌粉末和注射用浓溶液。注射液系指原料药物或与适宜的辅料制成的供注入体内的无菌液体制剂，包括溶液型、乳状液型或混悬型等注射液。可用于皮下注射、皮内注射、肌内注射、静脉注射、静脉滴注、鞘内注射、椎管内注射等。溶液型注射剂应澄清。除另有规定外，混悬型注射液中原料药物粒径应控制在15μm以下，含15～20μm（间有个别20～50μm）者，不应超过10%，若有可见沉淀，振摇时应容易分散均匀。混悬型注射液不得用于静脉注射（C对）或椎管内注射（AD对）；乳状液型注射液不得有相分离现象，不得用于椎管内注射（E对）。静脉用乳状液型注射液中90%的乳滴粒径应在1μm以下，不得有大于5μm的乳滴。除另有规定外，输液应尽可能与血液等渗。